有微生物参与的化学净化过程是
A. 中和酸废水
B. 有机氮化物分解
C. 乙拌磷杀虫剂在腐殖酸存在下分解
D. 氨基甲酸酯在天然水中通过自由基作用
E. 中和碱废水

正确答案：B。有机氮化物分解

解析：本题考查化学净化的相关内容。化学净化是由于进入水体的污染物与水中成分发生化学作用，致使污染物浓度降低或毒性消失的现象。包括污染物的分解与化合、氧化与还原、酸碱中和等作用。有微生物参与的化学净化过程是有机氮化物分解（B对ACDE错）。